心底朝向
A. 右前上方
B. 右前下方
C. 左前下方
D. 右后上方
E. 左后上方

正确答案：D。右后上方

解析：心底朝向右后上方（D对），主要由左心房和小部分的右心房构成。